下列关于男性尿道的描述何者正确
A. 在前列腺底近前缘处穿入前列腺
B. 在前列腺底近后缘处穿入前列腺
C. 在前列腺底近后缘处穿入前列腺后叶
D. 在前列腺底近后缘处穿入前列腺中叶
E. 在前列腺底近前缘处穿入前列腺侧叶

正确答案：A。在前列腺底近前缘处穿入前列腺

解析：男性尿道在前列腺底近前缘处进入前列腺（A对）。